沿海喜食海产品的地区发生的细菌性食物中毒以下列哪种为常见
A. 沙门菌中毒
B. 副溶血性弧菌中毒
C. 葡萄球菌中毒
D. 肉毒杆菌食物中毒
E. 河豚中毒

正确答案：B。副溶血性弧菌中毒